患者男性46岁，残根，患有慢性乙型肝炎20年，关于此类患者拔牙，下列说法错误的是
A. 肝炎急慢性期皆可拔牙
B. 术前应进行肝功检查
C. 肝功损害严重者术后易出血
D. 拔牙前应检查凝血酶原时间
E. 注意防止医源性交叉感染

正确答案：A。肝炎急慢性期皆可拔牙

解析：本题考查系统疾病对牙拔除术的影响及拔牙禁忌证-肝炎。肝炎急性期因肝功能损伤、凝血异常，拔牙后易导致感染、肝功能恶化、出血，应暂缓拔牙（A错，为本题的正确答案）。肝炎慢性期肝功能有明显损害者，因凝血酶原及凝血因子合成障碍，拔牙术后易出血（C对），因此术前应进行肝功能检查及凝血酶原时间检查（BD对），以确定是否可以拔牙。肝炎为传染性疾病，因此要对肝炎患者实施手术应注意病毒防护，避免院内感染（E对）。